患者咳吐大量脓血痰，腥臭异常，胸中烦满而痛，气喘不能卧，身热，烦渴，舌红苔黄腻，脉滑数。治疗应首选
A. 加味桔梗汤
B. 《千金》苇茎汤
C. 如金解毒散
D. 桔梗杏仁煎
E. 桑白皮汤

正确答案：A。加味桔梗汤

解析：题中患者以咳吐大量脓血痰为主症，故诊断为肺痈。血败肉腐，痈脓内溃外泄，故咳吐大量脓血痰，气味腥臭异常；脓毒蕴肺，肺气不利，则胸中烦满而痛，气喘不能卧；热毒内蒸，故身热，烦渴，舌红苔黄腻，脉滑数 。故诊断为肺痈溃脓期，治宜排脓解毒，方选加味桔梗汤加减（A对）。《千金》苇茎汤功能化痰泄热，通瘀散结消痈；如金解毒散功能降火解毒，清肺消痈，两方合用常治疗肺痈成痈期（BC错）。桔梗杏仁煎功能益气养阴，排脓解毒，为治疗肺痈恢复期选方（D错）。桑白皮汤功能清热肃肺化痰，为治疗喘证痰热郁肺证的选方（E错）。